下列受体与其激动剂搭配正确的是
A. α受体-去甲肾上腺素
B. β受体-可乐定
C. M受体-琥珀胆碱
D. N受体-毛果芸香碱
E. α受体-异丙肾上腺素

正确答案：A。α受体-去甲肾上腺素

解析：α肾上腺素受体激动药有：去甲肾上腺素、间羟胺、去氧肾上腺素（A对）。α₂受体-可乐定（B错）；Ν受体-琥珀胆碱（C错）；M受体-毛果芸香碱（D错）；β受体-异丙肾上腺素（E错）。